主要降低三酰甘油的调血脂药是
A. 瑞舒伐他汀
B. 利血平
C. 阿昔莫司
D. 依折麦布
E. 苯扎贝特

正确答案：E。苯扎贝特

解析：本题考查调血脂药。主要降低三酰甘油的调血脂药是苯扎贝特（E对）。瑞舒伐他汀（A错）为降低总胆固醇和低密度脂蛋白胆固醇的调血脂药。阿昔莫司（C错）为烟酸衍生物，可降低极低密度脂蛋白胆固醇和三酰甘油，升高高密度脂蛋白胆固醇。利血平（B错）属于交感神经末梢抑制剂。依折麦布（D错）为胆固醇吸收抑制剂。